上颌恒牙萌出顺序哪一个是正确的
A. 12435678
B. 12345678
C. 61245387
D. 61253478
E. 61243578

正确答案：E。61243578

解析：恒牙萌出顺序：上颌多为：第一磨牙、中切牙、侧切牙、第一前磨牙、尖牙、第二前磨牙、第二磨牙、第三磨牙；下颌多为：第一磨牙、中切牙、侧切牙、尖牙、第一前磨牙、第二前磨牙、第二磨牙、第三磨牙。上述为恒牙正常萌出的大致顺序，不同个体可能有差异。掌握“牙的萌出、更替及牙体解剖名词、标志”知识点。